初孕妇，26岁。妊娠38周，自觉胎动减少10小时入院。入院后B超检查提示羊水平段5厘米，无应激试验反应型，此时正确的处理措施是
A. 人工破膜
B. 间歇吸氧并严密观察
C. 复查无应激试验
D. 静脉滴注缩宫素
E. 米索前列醇引产

正确答案：B。间歇吸氧并严密观察

解析：青年初孕妇，妊娠38周（妊娠28周及以后为妊娠晚期），胎动减少，羊水平段5厘米（正常值为30～70mm），无应激试验反应型，此时正确的处理措施是间歇吸氧并严密观察（无应激实验反应型的处理是观察或者进一步评估）（B对）。人工破膜（P189）（A错）适用于宫口扩张≥3cm、无头盆不称、胎头已衔接而产程延缓者。复查无应激试验（C错）用于可疑型无应激试验。静脉滴注缩宫素（P189）（D错）适用于协调性宫缩乏力、宫口扩张≥3cm、胎心良好、胎位正常、头盆相称者。米索前列醇引产（E错）适用于延期妊娠或过期妊娠、母体疾病（如严重的糖尿病，高血压，肾病等）、胎膜早破，未临产者、胎儿因素（如可以胎儿窘迫，胎盘功能不良等）、死胎及胎儿严重畸形。